能敛汗固脱，防止大汗虚脱的药物是
A. 五味子
B. 莲子
C. 麻黄根
D. 山茱萸
E. 吴茱萸

正确答案：D。山茱萸

解析：山茱萸的应用于大汗不止，体虚欲脱的治疗，本品酸涩性温，能收敛止汗，固涩滑脱，为防止元气虚脱之要药。治疗大汗欲脱或久病虚脱者，常与人参、附子等同用如来复汤（D对）。五味子应用于久咳虚喘；自汗，盗汗；遗精，滑精；久泻不止；津伤口渴，消渴；心悸，失眠，多梦。（A错）。莲子的应用于遗精滑精；带下；脾虚泄泻；心悸，失眠（B错）。麻黄根的应用于自汗，盗汗，本品甘凉入心，能益心气，敛心液；轻浮走表，能实腠理、固皮毛、为养心敛液、固表止汗之佳品；2，骨蒸劳热。（C错）。吴茱萸的应用于寒凝疼痛，胃寒呕吐，虚寒泄泻（E错）。